血液缓冲系统缓冲
A. 固定酸
B. 挥发酸
C. 两者均可以缓冲
D. 两者均不可以缓冲
E. 无

正确答案：C。两者均可以缓冲

解析：血液缓冲系统缓冲主要有碳酸氢盐缓冲系统和非碳酸氢盐缓冲系统，其中固定酸的缓冲主要靠碳酸氢盐缓冲系统，挥发酸的缓冲主要靠非碳酸氢盐缓冲系统，所以血液缓冲系统缓冲两者均可以缓冲（C对）。